机体的生长发育，主要取决于
A. 血液的营养
B. 津液的滋润
C. 水谷精微充养
D. 肾精的充盛
E. 心血充盈

正确答案：D。肾精的充盛

解析：肾主生殖与发育，肾精肾气具有促进机体生长发育与生殖机能成熟的作用。肾藏精，精化气，肾精足则肾气充，则生长发育状态好；肾精亏则肾气衰，则生长发育状态差（D对）。血液（A错）由水谷精微所化生，含有人体所需的丰富的营养物质，对全身各脏腑组织器官起着濡养和滋润作用。津液（B错）是机体一切正常水液的总称，包括各脏腑形体官窍的内在液体及其正常的分泌物，津液是构成人体和维持生命活动的基本物质之一。水谷精微（C错）经过脾气的转输作用输送到各个脏腑，化为脏腑之精。心气旺盛，血脉充盛（E错），则面色红润光泽，面部的色泽，可以反映心血、心气的盛衰及其机能的强弱。其机理在于全身血气皆上注于面。